下列哪个器官不参与组成肝外胆道
A. 胆囊
B. 胆囊管
C. 副胰管
D. 肝总管
E. 胆总管

正确答案：C。副胰管

解析：参与组成肝外胆道的有胆囊(A对)，胆囊管(B对)，肝总管(D对)，胆总管(E对)，而副胰管不参与组成肝外胆道(C错，为本题正确答案)。